临床中常用于暂时冠的粘结的材料
A. 磷酸锌粘固剂
B. 树脂类粘固剂
C. 聚羧酸粘固剂
D. 玻璃离子粘固剂
E. 氧化锌丁香油粘固剂

正确答案：E。氧化锌丁香油粘固剂

解析：暂时冠的粘固应使用专用的暂时粘固剂，既要保证在戴用期间不松动脱落，又要方便在正式修复体试戴前取下。常用的暂时粘固剂是氧化锌丁香油水门汀，丁香油酚对牙髓有很好的安抚作用，可避免牙本质敏感。掌握“修复体试戴、磨光与粘固”知识点。